病例对照研究中不会出现的偏倚是
A. 选择偏倚
B. 信息偏倚
C. 回忆偏倚
D. 混杂偏倚
E. 失访偏倚

正确答案：E。失访偏倚

解析：本题考查病例对照研究中偏倚的类型。病例对照研究中常见的偏倚有：①选择偏倚（A对）：包括入院率偏倚、现患病例-新发病例偏倚、检出症候偏倚；②信息偏倚（B对）：包括回忆偏倚（C对）、调查偏倚；③混杂偏倚（D对）。失访偏倚（E错，为本题正确答案）是队列研究难以避免的一种偏倚。